儿童患佝偻病是由于体内缺乏
A. 钙
B. 铁
C. 视黄醇
D. 核黄素
E. 维生素D

正确答案：E。维生素D

解析：本题考查维生素D缺乏性佝偻病的相关内容。维生素D缺乏性佝偻病是由于儿童维生素D（E对ABCD错）缺乏导致钙磷代谢紊乱、长骨生长板软骨细胞分化异常、生长板软骨基质矿化和类骨质矿化障碍的一种骨病。婴幼儿（特别是小婴儿）生长发育迅速、户外活动较少，是发生维生素D缺乏性佝偻病的高危人群。